透皮吸收制剂中加入“Azone”的目的是
A. 增加塑性
B. 产生抑菌作用
C. 促进主药吸收
D. 增加主药的稳定性
E. 起分散作用

正确答案：C。促进主药吸收